关于脊髓丘脑束，何者错误
A. 其细胞体主要在对侧脊髓后角内
B. 由同侧脊髓丘脑侧束和脊髓丘脑前束合并而成
C. 穿过脑干三部分上行
D. 传导深部感觉
E. 终止于丘脑腹后外侧核

正确答案：D。传导深部感觉

解析：脊髓丘脑束是传导躯干和四肢浅感觉的纤维束之一。躯干和四肢痛温觉、粗略触觉和压觉传导通路中，传导痛温觉的纤维（细纤维）在后根的外侧部入脊髓后角内，再终止于第2级神经元；传导粗略触觉和压觉的纤维（粗纤维）经后根内侧部进入脊髓后角内，再终止于第2级神经元。第二级神经元发出纤维上升 1-2 个节段经白质前连合交叉到对侧的外侧索和前索内上行，组成脊髓丘脑侧束和脊髓丘脑前束（侧束传导痛温觉，前束传导粗略触觉和压觉）（B对D错，为本题正确选项）。由于经过白质前连合，交叉到对侧，所以脊髓丘脑束的细胞体在对侧脊髓后角内（A对）。经脑干三部分上行（C对），最后终止于丘脑腹后外侧核（E对）。